关于对乙酰氨基酚的说法，错误的是
A. 对乙酰氨基酚分子中含有酰胺键，正常储存条件下不易发生变质
B. 对乙酰氨基酚在体内代谢可产生乙酰氨基酚，引起肾毒性和肝毒性
C. 大剂量服用对乙酰氨基酚引起中毒时，可用谷胱甘肽或乙酰半胱氨酸解毒
D. 对乙酰氨基酚在体内主要与葡萄糖醛酸或硫酸结合，从肾脏排泄
E. 对乙酰氨基酚可与阿司匹林形成前药

正确答案：B。对乙酰氨基酚在体内代谢可产生乙酰氨基酚，引起肾毒性和肝毒性

解析：本题考查对乙酰氨基酚。N-乙酰基亚胺醌是对乙酰氨基酚的毒性代谢产物（B错，为本题正确答案）。对乙酰氨基酚主要在肝脏代谢，大部分与葡萄糖醛酸及硫酸结合，从尿中排泄（D对）。少量生成有毒的N-羟基乙酰氨基酚，进一步转化成毒性代谢物N-乙酰亚胺醌。在正常条件下，它可与肝内的谷胱甘肽结合而解毒。大剂量服用对乙酰氨基酚引起中毒时，可用谷胱甘肽或乙酰半胱氨酸解毒（C对）。对乙酰氨基酚分子中具有酰胺键，相对稳定，正常储存条件下不易发生变质（A对）。对乙酰氨基酚可与阿司匹林形成前药贝诺酯（E对），胃肠道反应减少。